低血糖出现交感神经兴奋症状是由于释放大量
A. 肾上腺素
B. 糖皮质激素
C. 胰高血糖素
D. 血管加压素
E. 生长激素

正确答案：A。肾上腺素

解析：低血糖症是一组多种病因引起的以血浆葡萄糖浓度过低，临床上以交感神经兴奋和脑细胞缺氧为主要特点的综合征。低血糖发作时交感神经过度兴奋症状的主要原因是因为交感神经和肾上腺髓质释放肾上腺素（A对）、去甲肾上腺素，表现为出汗、颤抖、心悸、紧张、焦虑、饥饿、流涎等症状。生长激素（E错）、糖皮质激素（B错）胰高血糖素（C错）为升糖激素，主要引起血糖升高，与交感神经兴奋表现关系不大。